对黄曲霉毒素最敏感的动物是
A. 兔
B. 大白鼠
C. 鸭雏
D. 猪
E. 小鼠

正确答案：C。鸭雏